异烟肼可引起的神经系统不良反应除外的是
A. 周围神经炎
B. 手脚麻木
C. 肌肉震颤
D. 步态不稳
E. 呕吐

正确答案：E。呕吐

解析：异烟肼可引起的神经系统不良反应为：常见反应为周围神经炎，表现为手脚麻木、肌肉震颤和步态不稳等。大剂量可出现头痛、头晕、兴奋和视神经炎，严重时可导致中毒性脑病和精神病。使用异烟肼时应注意及时补充维生素B6预防不良反应的产生。癫痫及精神病患者慎用。掌握“异烟肼、利福平及乙胺丁醇”知识点。